与内毒素有关的细菌结构是
A. 外膜蛋白
B. 脂多糖
C. 脂蛋白
D. 磷壁酸
E. 肽聚糖

正确答案：B。脂多糖

解析：内毒素是革兰氏阴性细菌细胞壁中的一种成分，叫做脂多糖。只在细菌被破坏时才被释放的细菌毒素。某些革兰阴性菌（如布鲁菌、肠杆菌、奈瑟菌、弧菌等）外膜相关的热稳定毒素，在固有免疫及B细胞的多克隆激活中发挥作用。掌握“细菌的大小、形态和基本结构”知识点。